《中国药典》规定，以苦杏仁苷为含量测定指标成分的中药是
A. 益智仁
B. 薏苡仁
C. 郁李仁
D. 酸枣仁
E. 沙苑子

正确答案：C。郁李仁

解析：本题考查的是郁李仁含量测定的指标成分。《中国药典》规定，以苦杏仁苷为含量测定指标成分的中药是郁李仁（C对）。郁李仁主要化学成分为郁李仁苷A、郁李仁苷B、苦杏仁苷、香草酸、原儿茶酸、熊果酸以及黄酮类化合物阿福豆苷、山柰苷等，《中国药典》以苦杏仁苷为指标成分进行含量测定，规定苦杏仁苷含量不得少于2.0%。